最基本的抽样方法，也是其他抽样方法的基础的是
A. 单纯随机抽样
B. 系统抽样
C. 分层抽样
D. 整群抽样
E. 多级抽样

正确答案：A。单纯随机抽样

解析：本题考查抽样调查的分类。最基本的抽样方法，也是其他抽样方法的基础的是单纯随机抽样（A对）。单纯随机抽样是按一定方式以同等的概率抽样。系统抽样（B错）又称间隔抽样、机械抽样。将抽样对象按次序编号，先随机抽取第一个调查对象，然后再按一定间隔随机抽样。分层抽样（C错）先将总体按某种特征分成若干个“层”，即组别或类型等，再在每个层中用随机方式抽取调查对象，再将每个层所有抽取的调查对象合成一个样本。整群抽样（D错）是以整群为抽样单位，从总体中随机抽取若干群为调查单位，然后对每个群内的所有对象进行检查。多级抽样（E错）又称多阶段抽样。在进行大规模调查时，常把抽样过程分为几个阶段，每个阶段可采用单纯随机抽样，也可将以上各种方法结合起来使用。